以下哪种疫苗不属于国家计划免疫的范畴
A. 卡介苗
B. 乙肝疫苗
C. 乙型脑炎疫苗
D. 脊髓灰质炎疫苗
E. 麻疹疫苗

正确答案：C。乙型脑炎疫苗

解析：乙型脑炎疫苗不属于国家计划免疫的范畴。掌握“儿童保健原则”知识点。